血浆半衰期最长钙离子通道阻滞药是
A. 硝苯地平
B. 尼卡地平
C. 氨氯地平
D. 尼索地平
E. 尼群地平

正确答案：C。氨氯地平